既治热毒血痢，又治阿米巴痢疾的药是
A. 射干
B. 白头翁
C. 马齿苋
D. 穿心莲
E. 白花蛇舌草

正确答案：B。白头翁

解析：本题考查的是白头翁的主治病证。既治热毒血痢，又治阿米巴痢疾的药是白头翁（B对）。白头翁：【主治病证】（1）热毒血痢。（2）阿米巴痢疾。射干（A错）：【主治病证】（1）咽喉肿痛（证属热结痰瘀者尤宜）。（2）痰多咳喘。（3）久疟疟母，闭经，痈肿，瘰疬、癥瘕。马齿苋（C错）：【主治病证】（1）热毒血痢，热毒疮疡。（2）血热崩漏、便血。（3）热淋，血淋。穿心莲（D错）：【主治病证】（1）温病初起，感冒发热，肺热咳喘，肺痈，咽喉肿痛。（2）痈疮疖肿，毒蛇咬伤。（3）湿热泻痢，热淋涩痛，湿疹。白花蛇舌草（E错）：【主治病证】（1）痈肿疮毒，咽喉肿痛，肠痈，毒蛇咬伤。（2）热淋涩痛，小便不利。（3）胃癌，食管癌，直肠癌。